通过抽样调查可实现的研究目的是
A. 为了早发现、早诊断、早治疗宫颈癌
B. 对个别发生的麻疹患者进行调查
C. 烟草消耗量与肺癌的关系研究
D. 对临床诊疗过程中遇见的某罕见疾病病例的临床表现、治疗与转归等进行描述
E. 为了获取某地高校学生的乙肝感染率

正确答案：E。为了获取某地高校学生的乙肝感染率

解析：本题考查抽样调查的目的。抽样调查是一种非全面调查，它是从全部调查研究对象中，抽选一部分单位进行调查，并据以对全部调查研究对象做出估计和推断的一种调查方法。如获取某地高校学生的乙肝感染率（E对ABCD错）。